能与四氢硼钾产生特征反应的是
A. 二氢黄酮
B. 5-羟基黄酮
C. 黄酮醇
D. 7-羟基黄酮
E. 异黄酮

正确答案：A。二氢黄酮